阿昔洛韦
A. 具有喹啉羧酸结构的药物
B. 具有咪唑结构的药物
C. 具有双三氮唑结构的药物
D. 具有单三氮唑结构的药物
E. 具有鸟嘌呤结构的药物

正确答案：E。具有鸟嘌呤结构的药物

解析：本题考查阿昔洛韦的结构。阿昔洛韦为开环核苷类抗病毒药物，结构中含有鸟嘌呤（E对）。有喹啉羧酸结构的药物（A错）为喹诺酮类抗菌药。氟康唑具有双三氮唑结构（C错）有氟康唑。具有咪唑结构的药物（B错）含有两个氮原子，如咪康唑。具有单三氮唑结构的药物（D错）有伏立康唑。